流行性出血热低血压休克期常发生在
A. 病程的第3～5日
B. 病程的第4～6日
C. 病程的第5～8日
D. 病程的第6～10日
E. 病程的第7～14日

正确答案：B。病程的第4～6日

解析：流行性出血热即肾综合征出血热，潜伏期为4～46天，一般为1～2周。典型病例表现为发热、低血压休克、少尿、多尿与恢复期五期经过。低血压休克期常在起病后3～7天（B对）出现，主要为低血容量休克的表现：心率加快，脉细弱，四肢厥冷，烦躁不安，意识模糊，口唇及四肢末端发绀，呼吸短促，尿少等。。病程的第3～5日（A错）常处于发热期，主要表现为发热、中毒症状、全身毛细血管损伤和肾脏损害。少尿期多始于病程第5～8天（C错），表现为血压上升，尿量锐减甚至尿闭。病程的第6～10日（D错）处于少尿期与多尿期的过渡阶段。病程的第7～14日（E错）为多尿期的出现时间，持续时间1天～数月，由于新生肾小管回吸收功能尚未完善，其功能恢复迟于肾小球滤过功能的修复，加之尿素氮等潴留物质引起高渗性利尿，使尿量逐渐增多。